女，67岁，劳力性呼吸困难4年，加重2天，4年前开始出现体力活动后呼吸困难，休息状态下症状消失，2天前呼吸困难加重后夜间不能平卧，高血压病史20年。查体：BP160/100mmHg，端坐呼吸，双肺底可闻及湿啰音，心率102次/分，P₂亢进，可闻及S₃奔马律，该患者不宜立即使用的药物是
A. 呋塞米
B. 硝酸甘油
C. 硝普钠
D. 吗啡
E. 美托洛尔

正确答案：E。美托洛尔

解析：患者老年女性，2天前出现呼吸困难加重后夜间不能平卧。既往COPD史20年，高血压病25年。查体：P102次/分（正常值60～100次/分），BP160/100mmHg。静脉注射呋塞米（A对）可快速利尿，还可扩张静脉，降低血压；硝酸甘油（B对）可扩张小静脉，降低回心血量，使LVEDP及肺血管压降低；静脉滴注硝普钠（C对）为动、静脉扩张剂，可迅速降低血压；静脉注射吗啡（D对）可使患者镇静，减少焦虑不安所带来的额外的心脏负担，同时舒张小血管而减轻心脏负荷，松弛支气管平滑肌改善通气；美托洛尔（E错，为本题正确选项）为β受体阻滞剂主要用于慢性心力衰竭的治疗，该患者为急性心力衰竭，不宜使用。